7岁儿童，发热、头痛、恶心、呕吐2天，嗜睡1天。查体：体温39.5℃，浅昏迷，瞳孔等大，对光反应良好，颈强（+），克氏征（+），胸腹部多个出血点。化验：WBC19×10⁹/L，N85%，最可能的诊断是
A. 结核性脑膜炎
B. 流行性脑脊髓膜炎
C. 流行性乙型脑炎
D. 流行性出血热
E. 中毒性细菌性痢疾

正确答案：B。流行性脑脊髓膜炎

解析：7岁患儿，发热头痛恶心呕吐2天（全身中毒症状），嗜睡1天（流行性脑脊髓膜炎败血症期临床表现）；查体体温39.5℃，浅昏迷，瞳孔等大，对光反应良好，颈强（+）、克氏征（+）脑膜刺激征阳性，（流行性脑脊髓膜炎脑膜炎期临床表现），胸腹部多个出血点（皮肤黏膜出血）；WBC19×10⁹/L（成人正常参考值4～10×10⁹/L），N85%（成人正常参考值0.5～0.7），根据患者的临床表现、体征和实验室结果，最可能的诊断是流行性脑脊髓膜炎（B对），简称为流脑，其主要临床表现是突发高热、剧烈头痛、频繁呕吐，皮肤黏膜瘀点、瘀斑及脑膜刺激征，严重者可有败血症休克和脑实质损害，常可危及生命。结核性脑膜炎（A错）起病缓慢，多于1～2周非特异性感染症状后，出现脑膜刺激征。流行性乙型脑炎（C错）为病毒感染，常表现为外周血白细胞轻度升高，且以淋巴细胞增多为主，无瘀点瘀斑。流行性出血热（D错）临床以发热、低血压休克、充血出血和肾损害为主要表现，有“三痛三红征”，多无脑膜刺激征。中毒型菌痢以严重毒血症，休克和（或）中毒性脑病为主，无瘀点瘀斑。